男性，65岁。陈旧性广泛前壁心肌梗死7年，活动后胸闷、心悸、气短2年，近1周出现夜间阵发性呼吸困难。体检：端坐呼吸，BP160/90mmHg，P120次/分。P₂亢进，心脏各瓣膜区未闻及杂音。双肺底可闻及细湿啰音，双肺散在哮鸣音。腹平软，肝脾肋下未触及，双下肢无水肿。空腹血糖4.2mmol/L。心电图：V₁～V₆导联ST段压低0.05～0.1mV。血清肌钙蛋白正常。该患者目前最可能的诊断是
A. 气道梗阻
B. 肺动脉栓塞
C. 支气管哮喘
D. 急性心肌梗死
E. 急性左心衰竭

正确答案：E。急性左心衰竭

解析：患者老年男性，既往有活动后胸闷心悸气短，近1周出现夜间阵发性呼吸困难，端坐呼吸，P₂亢进，双肺底可闻及细湿啰音，双肺散在哮鸣音，该患者目前最可能的诊断是急性左心衰竭（E对）。气道梗阻（A错）多引起吸气性呼吸困难，不会出现特异性的夜间阵发性呼吸困难和端坐呼吸。肺动脉栓塞（P100）（B错）多表现为突发呼吸困难、胸痛、咯血。支气管哮喘（P29）（C错）一般见于青年患者，多有过敏原接触史，典型症状为发作性伴有哮鸣音的呼气性呼吸困难。急性心肌梗死（D错）时心电图常表现为ST段弓背向上抬高或ST段压低≥0.1mV，肌钙蛋白（包括肌钙蛋白I和肌钙蛋白T）升高。